产地加工中，刮去大黄外皮时忌用
A. 竹器
B. 木器
C. 瓷器
D. 铜器
E. 铁器

正确答案：E。铁器

解析：本题考查的是大黄的采收加工。产地加工中，刮去大黄外皮时忌用铁器（E对）。大黄：【采收加工】秋末茎叶枯萎或次春植株发芽前采挖，除去泥土及细根，刮去外皮（忌用铁器），加工成卵圆形、圆柱形，或切成瓣、段、块、片，绳穿成串干燥或直接干燥。商品中以掌叶大黄产量大，唐古特大黄次之，药用大黄产量较少。